男孩，1岁。发热伴咳嗽3天，食欲差。偶有呕吐，嗜睡，抽搐2次，双肺可闻及中细湿啰音，心率110次/分，呼吸56次/分，肝肋下1cm，白细胞4×10⁹/L。还伴有凹陷性水肿，查血钠120mmol/L。可能的诊断是
A. 肾病综合征
B. 肾小球肾炎
C. 水电解质失衡
D. 膜性肾病
E. 抗利尿激素异常分泌综合征

正确答案：E。抗利尿激素异常分泌综合征

解析：患儿发热、咳嗽、双肺闻及中细湿啰音、呼吸频率增快，应诊断为急性支气管肺炎。患儿嗜睡、抽搐、肝肿大，应考虑为重症支气管肺炎。重症肺炎缺氧时常有抗利尿激素（ADH）分泌增加，使水钠潴留，导致凹陷性水肿；缺氧可使钠泵功能失调，使Na⁺进入细胞内，造成低钠血症（血钠≤130mmol/L）。故本例应该诊断为重症肺炎并抗利尿激素异常分泌综合征（E对）。肾病综合征常表现为大量蛋白尿、低蛋白血症（A错）。肾小球肾炎常表现为血尿水肿高血压一过性肾功能减退等（B错）。重症肺炎的水电解质失衡常表现为混合性酸中毒（C错）。膜性肾病属于肾病综合征的常见病因之一（D错）。